氰化物中毒时，氰离子与之亲合力最大的酶是
A. 细胞呼吸酶
B. 过氧化物酶
C. 血色素合成酶
D. 酮戊酸脱水酶
E. 巯基酶

正确答案：A。细胞呼吸酶

解析：本题考查氰化物中毒体征。氰化氢及其他氰化物的毒性，主要是其在体内解离出的氰离子（CN⁻）引起。CN⁻与细胞呼吸酶（A对BCDE错）的亲和力最大，使细胞色素失去传递电子的能力，阻断呼吸链，使组织不能摄取和利用氧造成“细胞内窒息”。